温病卫分证的脉象是
A. 浮紧
B. 滑数
C. 浮数
D. 洪数
E. 弦数

正确答案：C。浮数

解析：卫分证为外邪侵袭人体初期，卫阳在肌表抵御邪气抗争，脉气鼓动于外，故见脉浮；温热之邪鼓动气血，运行加速，故见脉数（C对）。